常引起心脏毒性的化疗药物是
A. 环磷酰胺
B. 甲氨蝶呤
C. 阿霉素
D. 长春新碱
E. 左旋门冬酰胺酶

正确答案：C。阿霉素

解析：常引起心脏毒性的化疗药物是阿霉素（C对），其是干扰转录过程和阻止RNA合成的抗肿瘤药物，其抗瘤谱广，疗效高，主要用于对常用抗肿瘤药耐药的急性淋巴细胞白血病或粒细胞白血病、恶性淋巴肉瘤、乳腺癌等。其最严重的毒性反应为心肌退行性变和心肌间质水肿的心脏毒性。环磷酰胺（A错）通过影响DNA结构与功能而发挥抗肿瘤作用，其不良反应除恶心、呕吐、腹泻和脱发外，最主要的毒性反应为骨髓抑制（表现为白细胞减少）和出血性膀胱炎。甲氨蝶呤（B错）是叶酸拮抗剂，这种抗代谢药的不良反应包括骨髓抑制（白细胞和血小板减少）、胃肠道毒性（口腔炎、胃炎、腹泻等）、脱发、皮疹和红斑等常见不良反应，还包括肾毒性、肝毒性、肺毒性、中枢神经系统毒性及致畸作用。长春新碱（D错）毒性反应主要包括骨髓抑制、神经毒性、消化道反应、脱发等，长春新碱对外周神经系统毒性较大。左旋门冬酰胺酶（E错）影响氨基酸供应，主要不良反应是超敏反应，可短暂抑制正常组织的蛋白质合成可出现低蛋白血症（白蛋白合成不良）和出血（凝血因子合成不良）等。